患者，男，32岁。素日嗜酒，外出着凉后，始见时时振寒，发热，继而壮热汗出，烦躁不宁，咳嗽气急。咳吐腥臭浊痰，胸满作痛，口干苦，便秘，舌红苔黄腻，脉滑数。治疗应首选
A. 清金化痰汤
B. 《千金》苇茎汤
C. 桑白皮汤
D. 加味泻白散
E. 《济生》桔梗汤

正确答案：B。《千金》苇茎汤

解析：题中患者咳吐腥臭浊痰的主症，故诊断为肺痈。患者平素嗜酒，蕴湿蒸痰化热，熏灼于肺，加之外感风寒，未及时表散，内蕴不解，郁而化热，邪热熏肺，两者共同致热盛血瘀，蕴酿成痈，发为肺痈。邪热入里，热毒内盛，正邪交争，故时时振寒，发热，继而壮热汗出；热毒扰心，故烦躁不宁；热毒壅肺，肺气上逆，失于肃降，故咳嗽气急；热壅血瘀，蕴酿成痈，肺络不和，气血瘀滞，故胸满作痛；痰浊瘀热熏蒸成痈，故咳吐腥臭浊痰；热入血分，耗伤津液，故口干口苦，便秘；舌红苔黄腻，脉滑数为痰热蕴结在肺之象，故辨为成痈期。治宜清肺解毒，化瘀消痈。千金苇茎汤功能化痰泄热，通瘀散结消痈，为肺痈成痈期的选方（B对）。清金化痰汤功能清热化痰，无解毒化瘀消痈之功（A错）。桑白皮汤功能清热肃肺化痰，用于治疗喘证痰热郁肺证或肺脏痰热郁肺证（C错）。加味泻白散功能顺气降火，清肺化痰，无解毒化瘀消痈之功（D错）。济生桔梗汤功能清肺化痰，排脓泄壅，用于肺痈溃脓期的治疗（E错）。